哪一支不在眶腔内
A. 眶下神经
B. 滑车神经
C. 上颌神经
D. 外展神经
E. 动眼神经

正确答案：C。上颌神经

解析：上颌神经经眶下裂入眶腔后改名为眶下神经，故上颌神经（C对）不在眶腔内而眶下神经（A错）在眶腔内。滑车神经（B错）、展神经（D错）、动眼神经（E错）均在眶腔内。